起矫味、矫臭作用，且在收胶时有利于气泡逸散的胶剂辅料是
A. 冰糖
B. 蜂蜜
C. 花生油
D. 黄酒
E. 明矾

正确答案：D。黄酒

解析：本题考查的是胶剂辅料的种类与作用。起矫味、矫臭作用，且在收胶时有利于气泡逸散的胶剂辅料是黄酒（D对）。胶剂辅料的种类与作用：①冰糖（A错）：色白、洁净无杂质者为佳。冰糖可增加胶剂的透明度和硬度，并有矫味作用。也可用白糖代替。②油类：可用花生油（C错）、豆油、麻油，纯净无杂质的新制油为佳，酸败者禁用。油可降低胶块的黏度，便于切胶，且在浓缩收胶时，油可促进锅内气泡的逸散，起消泡的作用。③酒类：多用绍兴黄酒，也可用白酒代替。酒起矫味矫臭作用，收胶时有利于气泡逸散。④明矾（E错）：色白洁净者为佳。可沉淀胶液中的泥沙杂质，增加胶剂的透明度。蜂蜜（B错）可做蜜丸的赋形剂。蜂蜜由于蜂蜜含有大量的糖、有机酸及维生素等丰富的营养成分，具有滋补作用；味甜能矫味；同时蜂蜜具有镇咳、缓下、润燥、解毒的作用。